下斜肌由何神经支配
A. 滑车神经
B. 动眼神经副交感纤维
C. 外展神经
D. 动眼神经躯体运动纤维
E. 眼神经

正确答案：D。动眼神经躯体运动纤维

解析：动眼神经含一般躯体运动纤维和一般内脏运动（副交感）纤维，动眼神经躯体运动纤维（D对）经海绵窦外侧壁后穿眶上裂入眶，支配上睑提肌、上直肌、内直肌、下斜肌、下直肌。动眼神经副交感纤维（B错）进入睫状神经节换元，节后纤维支配瞳孔括约肌、睫状肌。滑车神经（A错）支配上斜肌。外展神经（C错）支配外直肌。眼神经（E错）仅含躯体感觉纤维，接受来自眼鼻皮肤、黏膜等部位的感觉冲动。